根据《中药品种保护条例》，治疗特殊疾病的野生药材人工制成品，申请中药保护品种的保护期限和延长的保护期限分别为
A. 10年、10年
B. 10年、20年
C. 10年、14年
D. 7年、7年
E. 7年、10年

正确答案：A。10年、10年

解析：本题考查中药保护品种的等级划分和保护措施。根据《中药品种保护条例》，治疗特殊疾病的野生药材人工制成品，申请中药保护品种的保护期限和延长的保护期限分别为10年、10年（A对）。申请中药一级保护品种应具备的条件：符合下列条件之一的中药品种，可以申请一级保护。①对特定疾病有特殊疗效的；②相当于国家一级保护野生药材物种的人工制成品；③用于预防和治疗特殊疾病的。中药一级保护品种的保护期限分别为30年、20年、10年。因特殊情况需要延长保护期的，由生产企业在该品种保护期满前6个月，依照中药品种保护的申请办理程序申报。由国家药品监督管理部门确定延长的保护期限，不得超过第一次批准的保护期限。